中国药典（2000年版）中地西泮原料药中2-甲氨基-5-氯二苯酮的检查
A. 薄层色谱法
B. 高效液相色谱法
C. 气相色谱法
D. 沉淀法
E. 比色法

正确答案：A。薄层色谱法